下述维生素C注射液处方中，抗氧剂是
A. 维生素C104g
B. 依地酸二钠0.05g
C. 碳酸氢钠49g
D. 亚硫酸氢钠2g
E. 注射用水加至1000ml

正确答案：D。亚硫酸氢钠2g

解析：本题考查维生素C注射液的处方分析。维生素C注射液处方分析：维生素C（A错）-主药；依地酸二钠（B错）-金属螯合剂；碳酸氢钠（C错）-pH调节剂；亚硫酸氢钠（D对）-抗氧剂；注射用水（E错）-溶剂。